抑木扶土法的理论依据是
A. 五行相生
B. 五行相乘
C. 五行相侮
D. 五行相克
E. 五行母子相关

正确答案：B。五行相乘

解析：本题考查的是抑木扶土法的理论依据。抑木扶土法的理论依据是五行相乘（B对）。抑木扶土法：疏肝健脾或平肝和胃的治法，又称疏肝健脾法、调和肝胃法，适用于木旺乘土或土虚木乘之证。具体应用时，对木旺乘土之证，以抑木为主，扶土为辅；对土虚木乘之证，以扶土为主，抑木为辅。